关于胃酸的生理作用的叙述，错误的是
A. 激活胃蛋白酶原
B. 促进蛋白质变性，易于分解
C. 促进维生素B₁₂的吸收
D. 进入小肠后可促进胰液、胆汁和小肠液的分泌
E. 促进铁和钙的吸收

正确答案：C。促进维生素B₁₂的吸收